关于社会医学学科性质不正确的描述是
A. 具有自然科学与社会科学双重性质的交叉学科
B. 医学与社会学之间交叉的产物
C. 连接了自然科学与社会科学两大领域
D. 综合了生物医学与社会科学的研究方法
E. 临床医学与生物遗传学之间交叉的产物

正确答案：E。临床医学与生物遗传学之间交叉的产物